化学成分主要为碳酸钙的药材有
A. 石决明
B. 地龙
C. 珍珠
D. 水蛭
E. 全蝎

正确答案：A、C。石决明；珍珠

解析：本题考查的是石决明与珍珠的成分。化学成分主要为碳酸钙的药材有石决明（A对）、珍珠（C对）。石决明【成分】主含碳酸钙及多种氨基酸、壳角质、胆素、微量元素等。尚含少量镁、铁、磷酸根、硅酸根、氯离子及微量碘。珍珠【成分】主含碳酸钙（海水珍珠95.66%，淡水珍珠94.45%）、壳角蛋白（海水珍珠4%，淡水珍珠3.83%），少量的卟啉和色素以及无机元素Mg、Mn、Sr、Cu、Al、Na、Zn等。地龙（B错）【成分】主含蛋白质。另含琥珀酸，具平喘、利尿作用；次黄嘌呤，具平喘、降压作用；蚯蚓解热碱，具解热作用；蚯蚓素，具溶血作用等。水蛭（D错）含蛋白质。此外，尚含肝素，抗凝血酶等抗凝血物质。全蝎（E错）【成分】含蝎毒素，为一种含碳、氢、氧、氮、硫等元素的毒性蛋白，与蛇的神经毒素类似，但含硫量较高。此外，尚含三甲胺、甜菜碱、牛磺酸、卵磷脂及铵盐等。